下列有关主动整塑说法不正确的是
A. 吞咽
B. 大张口
C. 牵拉患者唇部
D. 轻轻活动上唇
E. 伸舌向前并左右摆动

正确答案：C。牵拉患者唇部

解析：主动整塑包括大张口，轻轻活动上唇和下唇，吞咽，伸舌向前并左右摆动。掌握“局部义齿的印模和模型”知识点。